以下哪项不是扁平苔藓的病理表现
A. 上皮不全角化
B. 基底细胞液化变性
C. 黏膜固有层淋巴细胞带状浸润
D. 出现胶样小体
E. 胶原纤维变性

正确答案：E。胶原纤维变性

解析：本题考查扁平苔藓的病理表现。胶原纤维变性（E错，为本题的正确答案）不是扁平苔藓的表现，而是盘状红斑狼疮等疾病的病理表现。口腔扁平苔藓（OLP）是一种常见口腔黏膜慢性炎症性疾病。典型病理表现为：上皮不全过度角化（A对），基底细胞液化变性（B对），黏膜固有层淋巴细胞带状浸润（C对）。棘层、基底层或固有层内出现胶样小体（D对）。